水肿的关键病位是
A. 心
B. 肝
C. 肺
D. 脾
E. 肾

正确答案：E。肾

解析：水肿若肺、脾、肾三脏功能严重受损，后期可影响到心、肝（AB错）。水肿在发病机理上，肺、脾、肾三脏相互联系和相互影响。肺与肾的关系上是母子相传，若肾虚水泛，上逆于肺，可致肺气不降，通调水道功能失调，同时使肾气更虚加重水肿；反之，肺受邪传入肾时，亦可形成相同的结果。脾与肾在关系上是相制相助，如脾虚不能制水，水湿壅滞，必损其阳，因此脾虚进一步发展，必然导致肾阳虚衰，反之肾阳衰微不能温养脾土，脾肾俱虚，使水肿进一步加重。因此，肺脾肾在水肿的发病上，以肾为本，以肺为标，以脾为制水之脏，故关键病位为肾（CD错）（E对）。